下列不是病因推断标准的是
A. 关联的合理性与一致性
B. 关联的时间顺序
C. 关联的剂量-反应关系
D. 关联有无统计学意义
E. 关联的强度

正确答案：D。关联有无统计学意义